肝病患者使用的抗结核病药
A. 地高辛
B. 乙胺丁醇
C. 洋地黄毒苷
D. 螺内酯
E. 利福平

正确答案：B。乙胺丁醇